有形实邪闭阻气机所致的疼痛为
A. 胀痛
B. 灼痛
C. 冷痛
D. 绞痛
E. 隐痛

正确答案：D。绞痛

解析：绞痛（D对）是指痛势剧烈，如刀绞割的症状。多因有形实邪阻闭气机，或寒邪凝滞气机所致。如心脉痹阻所引起的“真心痛”，结石阻滞胆管所引起的上腹痛，寒邪犯胃所引起的胃脘痛等，皆具有绞痛的特点。胀痛（A错），指疼痛兼有胀感或胀甚于痛。是气滞作痛的特点。灼痛（B错），指疼痛有灼热感而喜凉的症状。火邪窜络所致者，为实证；阴虚火旺所致者，为虚证。冷痛（C错），指疼痛有冷感而喜暖的症状。常因寒邪侵袭所致。隐痛（D错），指疼痛不剧烈，尚可忍耐，但绵绵不休的症状。多因阳气精血亏虚，脏腑经脉失养所致。